以下哪穴不是足太阳膀胱经的五输穴
A. 昆仑
B. 飞扬
C. 束骨
D. 委中
E. 足通谷

正确答案：B。飞扬

解析：足太阳膀胱经的五输穴分别为井穴至阴，荥穴足通谷（E对），输穴束骨（C对），经穴昆仑（A对），合穴委中（D对）。飞扬为足太阳膀胱经络穴（B错，为本题正确答案）。